解热镇痛作用强而抗炎作用很弱的药物是
A. 吲哚美辛
B. 吡罗昔康
C. 布洛芬
D. 双氯芬酸
E. 对乙酰氨基酚

正确答案：E。对乙酰氨基酚

解析：对乙酰氨基酚为非处方药，解热镇痛作用与阿司匹林相当，但抗炎作用极弱。掌握“对乙酰氨基酚、布洛芬、塞来昔布”知识点。